肥胖是下列哪种风湿病的易感因素
A. 强直性脊柱炎
B. 骨性关节炎
C. 类风湿关节炎
D. 反应性关节炎
E. 银屑病性关节炎

正确答案：B。骨性关节炎

解析：骨性关节炎（B对）是一种退行性病变，由于年龄、肥胖、劳损、创伤、关节先天性异常、关节畸形等诸多因素引起的病变。强直性脊柱炎（A错）病因迄今未明，一般认为是一组多基因遗传病，与MHCⅠ类基因HLA-B27高度相关（P825）。类风湿关节炎（C错）是遗传易感因素、环境因素、及免疫系统失调等各种因素综合作用的结果（P807）。反应性关节炎（D错）是和感染相关的风湿病，主要与感染、遗传标记和免疫失调有关。银屑病性关节炎（E错）与遗传与感染因素有关。A、C、D、E选项均与肥胖无关。